在胃肠道局部大量分泌的免疫球蛋白是
A. IgG
B. IgM
C. IgD
D. IgE
E. IgA

正确答案：E。IgA